预防接触性皮炎的最佳措施是
A. 勤洗澡，注意卫生
B. 接触病人后，肥皂水洗手
C. 查明病因，避免再次接触刺激物
D. 注意隔离，防止接触感染
E. 病人使用的帽子，梳子要消毒

正确答案：C。查明病因，避免再次接触刺激物

解析：接触性皮炎是指因皮肤或黏膜接触某些外界致病物质所引起的皮肤急性或慢性炎症反应。其临床特点是发病前均有明显的接触某种物质的病史，好发于接触部位，皮疹上有红斑、丘疹、水疱、糜烂、渗出、结痂等。将可疑致敏物用适当溶剂配成一定比例的浓度做斑贴试验，若示阳性则提示患者对被试物过敏。本病以清热祛湿止痒为主要治法。首先应避免接触过敏物质（C对），否则治疗无效。急性者以清热祛湿为主，慢性者以养血润燥为主。